患者死亡，医患双方当事人不能确定死因或者对死因有异议的，应当尸检。当地不具备尸体冻存条件的，尸检的期限是在患者死亡后
A. 12小时内进行
B. 24小时内进行
C. 36小时内进行
D. 48小时内进行
E. 60小时内进行

正确答案：D。48小时内进行

解析：根据《医疗事故处理条例》第十八条规定：患者死亡，医患双方当事人不能确定死因或者对死因有异议的，应当在患者死亡后48小时内进行尸检（D对），具备尸体冷冻条件的，可以延长至7日。